舌下腺囊肿的处理方法目前常用
A. 袋形缝合
B. 尽可能摘除囊肿
C. 引流囊液
D. 完整摘除囊肿
E. 切除舌下腺

正确答案：E。切除舌下腺

解析：根治舌下腺囊肿的方法是切除舌下腺，残留部分囊壁不致造成复发。掌握“舌下腺及唾液腺黏液囊肿”知识点。